当遭遇困难迫切需要寻求别人帮助时，最需掌握的生活技能是
A. 人际关系能力
B. 创造性思维能力
C. 缓解压力的能力
D. 同理能力
E. 有效交流能力

正确答案：E。有效交流能力